婴幼儿上颌骨骨髓炎的感染多来源于
A. 牙源性
B. 血源性
C. 损伤性
D. 腺源性
E. 医源性

正确答案：B。血源性

解析：本题考查面颈部淋巴结炎。新生儿颌骨骨髓炎的感染来源多为血源性（B对），但亦可因牙龈损伤或母亲患化脓性乳腺炎，哺乳时病原菌直接侵入而引起。脓性中央性颌骨骨髓炎。口腔颌面外科临床上很少见到初治的新生儿颌骨骨髓炎，因初发病时大多在产科及小儿科就诊，待转入慢性期后始到口腔颌面外科诊治，此时患儿早已度过新生儿期，可称为婴幼儿骨髓炎。